休克Ⅲ期又称：
A. 弥漫性血管内凝血期
B. 微循环衰竭期
C. 细胞损伤期
D. 多器官障碍期
E. 休克不可逆期

正确答案：B。微循环衰竭期

解析：20世纪60年代，Richard C. Lillehei等对休克的微循环变化进行了深入研究，并以失血性休克为例，将休克病程分为三期：微循环缺血期、微循环淤血期、微循环衰竭期（B对）。弥漫性血管内凝血（A错）、细胞损伤（C错）和多器官障碍（D错）是休克Ⅲ期的临床表现。微循环衰竭期又称难治期、 DIC期。有学者认为休克进入此期便不可逆，故又称不可逆期（E错）。